Ⅱ类洞型咬合面鸠尾形设计根据
A. 邻面龋的深浅
B. 邻面洞的位置
C. 邻面龋的牙位
D. 邻面龋的类型
E. 邻面缺损的大小

正确答案：E。邻面缺损的大小

解析：本题考查鸠尾固位。Ⅱ类洞型咬合面鸠尾形设计根据邻面缺损的大小（E对）。鸠尾的制备要求与邻面缺损大小相匹配，使充填体在受力时保持平衡。鸠尾要有一定深度，特别在峡部，以获得足够抗力。在预备鸠尾时应顺（牙合）面的窝洞扩展，避开牙尖、嵴和髓角。鸠尾峡的宽度一般在后牙为所在颊舌尖间距的1/4～1/3，前牙为邻面洞舌方宽度的1/3～1/2。鸠尾峡的位置应在轴髓线角的内侧，（牙合）面洞底的（牙合）方。